毛果芸香碱属
A. 麻醉药品
B. 精神药品
C. 两者都是
D. 两者都不是

正确答案：D。两者都不是

解析：本题考查毒性药品。毛果芸香碱属毒性药品（D对）。毒性药品是指毒性剧烈，治疗剂量与中毒剂量相近，使用不当致人中毒或死亡的药品。毛果芸香碱用于治疗原发性青光眼，按卫生部规定，毛果芸香碱属于西药毒性药品。毒性药品西药品种共13种：去乙酰毛花苷丙、阿托品、洋地黄毒苷、氢溴酸后马托品、三氧化二砷、毛果芸香碱、升汞、水杨酸毒扁豆碱、氢溴酸东莨菪碱、亚砷酸钾、士的宁、亚砷酸注射液、A型肉毒毒素及其制剂。麻醉药品（A错）是指对中枢神经有麻醉作用，连续使用、滥用或者不合理使用，易产生身体依赖性和精神依赖性，能成瘾癖的药品。精神药品（B错）可以直接作用于中枢神经系统，使之极度兴奋或抑制。